某患儿，6岁，先天性唇腭裂术后，伴牙槽突裂，什么时间修复牙槽裂最适宜
A. 6岁
B. 7～8岁
C. 9～11岁
D. 12～14岁
E. 16岁以后

正确答案：C。9～11岁

解析：本题考查唇腭裂的序列治疗。牙槽突植骨术一般于9～11岁（C对）时进行，即尖牙未萌根形成2/3时。9～11岁上颌骨发育已基本完成，此时手术可以避免对上颌骨生长发育的不利影响。